硝苯地平对于以下哪种组织的作用最敏感
A. 心脏静脉
B. 外周静脉
C. 脑部静脉
D. 骨骼动脉
E. 冠状动脉

正确答案：E。冠状动脉

解析：血管平滑肌对钙通道阻滞药的作用很敏感。该类药物能明显舒张血管，主要舒张动脉，对静脉影响较小。动脉中又以冠状血管较为敏感，能舒张大的输送血管和小的阻力血管，增加冠脉流量及侧支循环量。掌握“钙通道阻滞药药理作用和不良反应”知识点。